化学毒物引起突变类型不包括
A. 基因突变
B. 癌变
C. 染色体畸变
D. 染色体数目异常

正确答案：B。癌变

解析：本题考查化学毒物引起的突变类型。化学毒物引起的突变类型包括基因突变（A对）、染色体畸变（C对）和染色体数目异常（D对）。癌变（B错，为本题正确答案）是体细胞突变的类型。